寒热平调消痞散结的方剂是
A. 茵陈蒿汤
B. 青蒿鳖甲汤
C. 半夏泻心汤
D. 四逆散
E. 蒿芩清胆汤

正确答案：C。半夏泻心汤

解析：半夏泻心汤方含半夏、干姜、黄芩、黄连、人参、大枣、炙甘草，可寒热平调，消痞散结（C对），主治寒热互结之痞证-以辛温之半夏为君，可散结除痞；半夏辛温、干姜辛热，与苦寒之黄芩、黄连合用，为寒热并用，以和其阴阳，平调寒热。茵陈蒿汤的功用为清热利湿退黄（A错）。青蒿鳖甲汤的功用为养阴透热（B错）。四逆散的功用为透邪解郁，疏肝理脾（D错）。蒿芩清胆汤的功用为清胆利湿，和胃化痰（E错）。